在流行病学的抽样研究中，下列那项是错误的
A. 注意抽样方法
B. 减少抽样误差
C. 样本越大越好
D. 杜绝重复、遗漏
E. 限制调查范围

正确答案：C。样本越大越好

解析：本题考查抽样调查的基本原则。抽样调查的基本原则包括：随机抽样的样本的获得需要：①遵循随机化原则，即保证总体中每一个对象都有已知的、非零的概率被选为研究对象，以保证样本的代表性；②样本量足够大（C错，为本题正确答案）、调查数据可靠、分析正确。